患者女，20岁。突感胸闷，呼吸困难，大汗。查体：口唇微发绀，呼吸急促，听诊双肺布满干啰音，心率95次/分，既往有类似发作，有时休息后可缓解为缓解症状，首选的措施是
A. 静脉注射安定
B. 吸入沙丁胺醇或舒喘灵气喷雾
C. 喷吸激素
D. 口服强的松
E. 吸氧

正确答案：B。吸入沙丁胺醇或舒喘灵气喷雾

解析：哮喘的诊断：1.反复发作喘息、呼吸困难、胸闷或咳嗽（患者胸闷，呼吸困难，呼吸急促）。2.发作时在双肺可闻及散在或弥漫性以呼气相为主的哮鸣音，呼气相延长（患者肺部干啰音）。3.上述症状可经治疗缓解或自行缓解（患者有时休息后可缓解）。支气管舒张剂包括β₂受体激动剂，作为激素的补充治疗，是缓解轻中度急性哮喘症状的首选药物（B对）。安定具有抑制呼吸中枢的作用，可促使呼吸变浅、次数减少，从而加重缺氧和二氧化碳的潴留（A错）。重度至危重度哮喘使用喷吸激素（C错）。病情好转（3～5日）后可改为口服泼尼松（每日30～40mg）（D错）。重度至危重度哮喘采用氧疗，一般吸入氧浓度为25%～40%，并应注意湿化，可用鼻导管或面罩吸氧，使其保持PaO₂＞60mmHg，SaO₂≥90%，监测血氧，注意预防氧中毒（E错）。